男，70岁。高血压病20年，血压最高180/80mmHg，服用福辛普利血压控制150～160/60～70mmHg。为了有效控制血压，最佳的联合用药方案是
A. 利尿剂+β受体阻滞剂
B. β受体阻滞剂+钙通道阻滞剂
C. ACEI+钙通道阻滞剂
D. α受体阻滞剂+β受体阻滞剂
E. 利尿剂+钙通道阻滞剂

正确答案：C。ACEI+钙通道阻滞剂

解析：老年男性患者，高血压病20年，血压最高180/80mmHg（3级高血压），服用福辛普利血压控制150～160/60～70mmHg（控制效果不理想），故患者为了有效控制血压，此时应该联合用药，首选的是ACEI/ARB+二氢吡啶类CCB，即最佳的联合用药方案是ACEI抑制剂+钙通道阻滞剂（C对）。利尿剂+β受体阻滞剂（A错）、α受体阻滞剂+β受体阻滞剂（D错）为次选方案。β受体阻滞剂+钙通道阻滞剂（B错）、利尿剂+钙通道阻滞剂（E错）虽然也是推荐应用方案，但此患者用了福辛普利（ACEI）亦有降压效果，故无需换药，只需联合用药即可。